某女、38岁。思虑伤脾，症见胸闷、脘腹胀痛、不思饮食。宜选用的中药是
A. 甘松
B. 青皮
C. 玫瑰花
D. 枳实
E. 香橼

正确答案：A。甘松

解析：本题考查甘松的主治病证。宜选用的中药是甘松（A对）。甘松【主治病证】（1）思虑伤脾或寒郁气滞引起的胸闷、脘腹胀痛、不思饮食。（2）湿脚气。青皮（B错）【主治病证】（1）肝气郁滞之胸胁、乳房胀痛或结块，乳痈，疝气痛。（2）食积脘腹胀痛。（3）癥瘕积聚，久疟癖块。玫瑰花（C错）【主治病证】（1）肝胃气滞之胸胁脘腹胀痛。（2）肝郁血瘀之月经不调、乳房胀痛。（3）外伤肿痛。枳实（D错）【主治病证】（1）食积便秘胀痛。（2）泻痢里急后重。（3）痰湿阻滞之胸脘痞满，痰滞胸痹证。（4）胃扩张，胃下垂，脱肛，子宫脱垂。香橼（E错）【主治病证】（1）肝郁气滞之胸闷胁痛。（2）脾胃气滞之脘腹胀痛。（3）咳嗽痰多。